复合树脂充填不能使用的基底料是
A. 丁香油水门汀
B. 磷酸锌水门汀
C. 聚羧酸锌水门汀
D. 氢氧化钙制剂

正确答案：A。丁香油水门汀

解析：本题考查垫底。丁香油水门汀中的丁香酚是一种自由基聚合阻聚剂，在复合树脂充填物下用丁香油水门汀作为基底材料垫底，将影响树脂的固化（A错，为本题的正确答案）。磷酸锌水门汀不会影响树脂的聚合，但充填入牙齿时的酸性可能刺激牙髓，因此在中等深度窝洞需要封闭窝洞后再直接垫底，深龋时只能作间接垫底材料（B对）。聚羧酸锌水门汀（C对）、氢氧化钙制剂（D对）均不会对树脂的聚合造成影响且对牙髓无刺激均可用作树脂充填的直接或间接基底料。